流行性脑脊髓膜炎属于
A. 变质性炎症
B. 浆液性炎症
C. 增生性炎症
D. 化脓性炎症
E. 出血性炎症

正确答案：D。化脓性炎症

解析：流行性脑脊髓膜炎是由脑膜炎双球菌感染引起的脑脊髓膜的急性化脓性炎症（D对）。变质性炎症（A错）指的是实质炎症细胞明显的变性和坏死，主要发生于心、肝、肾、骨骼肌等实质器官。浆液性炎症（P75）（B错）以浆液渗出为特点，主要发生于黏膜、浆膜、滑膜和疏松结缔组织等。增生性炎症（C错）以实质细胞和间质细胞的增生为主，如伤寒病。出血性炎症（P76）（E错）指的是炎症病灶的血管损伤，常见于流行性出血热、钩端螺旋体病和鼠疫等。